龋损损害呈三角形，底部朝向釉质表面，尖端朝向牙本质为哪种龋病的特点
A. 平滑面龋
B. 窝沟龋
C. 线性釉质龋
D. 根面龋
E. 隐匿性龋

正确答案：A。平滑面龋

解析：平滑面龋损害呈三角形，其底朝向釉质表面，尖朝向牙本质。掌握“龋病的临床表现与分类”知识点。